有关女性生殖器结核病理，正确的是
A. 输卵管结核多为双侧性
B. 输卵管结核常由子宫内膜结核蔓延而来
C. 宫颈结核较多见，呈菜花状
D. 卵巢结核易侵犯卵巢深层
E. 盆腔腹膜结核多合并子宫内膜结核

正确答案：A。输卵管结核多为双侧性

解析：输卵管结核多为双侧性（A对），占女性生殖器结核的90%～100%，即几乎所有的生殖器结核均累及输卵管。子宫内膜结核常由输卵管结核蔓延而来（B错），占生殖器结核的50%～80%。宫颈结核常由子宫内膜结核蔓延而来或经淋巴或血循环传播，较少见，占生殖器结核的10%～20%，病变呈乳头状增生或为溃疡（C错）。因有白膜包围，卵巢结核不易侵犯卵巢深层（D错）。盆腔腹膜结核多合并输卵管结核（E错）。